属于医疗用毒性药品的是
A. 乌梢蛇
B. 猪苓
C. 斑蝥
D. 天然牛黄

正确答案：C。斑蝥

解析：本题考查医疗用毒性药品。属于医疗用毒性药品的是斑蝥（C对）。毒性药品中药品种共27种，包括砒石（红砒、白砒）、砒霜、水银、生马钱子、生川乌、生草乌、生白附子、生附子、生半夏、生南星、生巴豆、斑蝥（C对）、青娘虫、红娘子、生甘遂、生狼毒、生藤黄、生千金子、生天仙子、闹羊花、雪上一枝蒿、白降丹、蟾酥、洋金花、红粉、轻粉、雄黄。乌梢蛇（A错）为国家重点保护野生药材名录二级保护药材。猪苓（B错）为国家重点保护野生药材名录三级保护药材。